对职业人群进行医学监护的内容不包括
A. 定期体检
B. 就业前体检
C. 职业有害因素监测
D. 离岗或转岗时体检
E. 职业病的健康筛检

正确答案：C。职业有害因素监测

解析：用人单位应当按照国务院安全生产监督管理部门的规定，定期对工作场所进行职业病危害因素检测、评价。职业有害因素监测（C错，为本题正确答案）属于用人单位对工作场所进行的职业病危害因素监测、评价，不属于对于职业人群所进行的医学监护。对从事接触职业病危害的作业的劳动者，用人单位应当按照国务院安全生产监督管理部门、卫生行政部门的规定组织定期体检（A对）、就业前体检（B对）、离岗和转岗时的体检（D对）和职业病的健康筛查（E对），并将检查结果书面告知劳动者。